石韦除能利尿通淋、清肺止咳外，还能
A. 清心除烦
B. 渗湿止泻
C. 凉血止血
D. 通经下乳
E. 清解暑热

正确答案：C。凉血止血

解析：本题考查的是石韦的功效。石韦除能利尿通淋、清肺止咳外，还能凉血止血（C对）。石韦：【功效】利尿通淋，凉血止血，清肺止咳。灯心草：【功效】利尿通淋，清心除烦（A错）。车前子：【功效】利水通淋，渗湿止泻（B错），明目，清肺化痰。木通：【功效】利水通淋，泄热，通经下乳（D错）。滑石：【功效】利尿通淋，清解暑热（E错）；外用清热收湿敛疮。